手厥阴心包经的郄穴是
A. 地机
B. 养老
C. 中都
D. 郄门
E. 粱丘

正确答案：D。郄门

解析：该题考查十六经脉的郄穴。手厥阴心包经的郄穴是郄门（D对），地机为足太阴脾经的郄穴（A错），养老为手太阳小肠经的郄穴（B错），中都为足厥阴肝经的郄穴（C错），梁丘为足阳明胃经的郄穴（E错）。